诊断尖锐湿疣的特异性细胞是
A. 猫头鹰细胞
B. 挖空细胞
C. CD4+T淋巴细胞
D. 巨细胞
E. B淋病细胞

正确答案：B。挖空细胞

解析：尖锐湿疣是由人乳头瘤病毒（HPV）感染所致的以肛门生殖器部位增生性损害为主要表现的性传播疾病。组织病理学典型表现为表皮乳头瘤样增生伴角化不全，颗粒层和棘层上部细胞可有明显的空泡形成，胞质着色淡，核浓缩深染，核周围有透亮的晕，称为挖空细胞，为特征性改变（B对）。巨细胞病毒感染后的细胞行吉姆萨染色，可见到细胞核变大，有包涵体形成，核内包涵体周围与核膜间有一“轮晕”，被称为猫头鹰细胞（A错）。